医疗卫生机构违反条例规定，公开艾滋病病人信息的，应依照哪项法规予以处罚
A. 执业医师法
B. 艾滋病防治条例
C. 医疗机构管理条例
D. 传染病防治法
E. 保密法

正确答案：D。传染病防治法

解析：医疗卫生机构违反规定，公开艾滋病病毒感染者、艾滋病病人或者其家属的信息的，依照传染病防治法的规定予以处罚。掌握“艾滋病的预防与控制、治疗与法律责任”知识点。